女，58岁。发热，左胸痛3天。查体：T37.5℃，BP150/90mmHg，左下肺呼吸音减弱，可闻及双相摩擦音，心率100次/分。该患者最可能的诊断是
A. 肺炎
B. 自发性气胸
C. 心肌梗死
D. 肺栓塞
E. 胸膜炎

正确答案：E。胸膜炎

解析：患者为老年女性，发热，左胸痛，左下肺呼吸音减弱，可闻及双相摩擦音，根据其临床表现和体征，考虑诊断为是胸膜炎（E对）（具有胸膜炎的典型症状及体征）。肺炎（A错）的典型症状为高热、咳嗽、咳痰，很少闻及双相摩擦音。自发性气胸（P25）（B错）有突然加重的呼吸困难，并伴有明显的发绀，患侧肺部叩诊鼓音，听诊呼吸音减弱或消失。肺栓塞（P100）（D错）的典型症状为呼吸困难、胸痛和咯血，若伴有胸腔积液时，可有胸腔积液的体征，没有双相摩擦音。心肌梗死（P230）（C错）的典型症状为胸前区压榨性疼痛，休息和含有硝酸甘油不能缓解，可有心包摩擦音，为反应性纤维性心包炎所致，当呼吸运动停止时，此杂音仍存在。